六淫致病，其性干涩，易伤津液的是
A. 风邪
B. 寒邪
C. 暑邪
D. 燥邪
E. 火邪

正确答案：D。燥邪

解析：燥邪为干涩之病邪，侵犯人体，最易损伤津液（D对）。火（热）易炎上动血（A错）。湿性重浊黏滞（B错）。风邪善行数变（C错）。寒性收引凝滞（E错）。